关于霍乱的描述，不正确的是
A. 霍乱是由霍乱弧菌引起的烈性肠道传染病
B. 泻吐期多数以无痛性急剧腹泻开始，伴有里急后重
C. 呕吐常为喷射性
D. 脱水及时纠正后，多数症状消失
E. 少数患者有反应性发热

正确答案：B。泻吐期多数以无痛性急剧腹泻开始，伴有里急后重

解析：无痛性腹泻是发病的第一个症状，并不伴有里急后重（B错，为本题正确答案）；霍乱是由霍乱弧菌所致的烈性肠道传染病（A对），发病急、传播快，泻吐期先泻后吐，呕吐一般发生在腹泻后，多为喷射状（C对），呕吐物为米泔水样液体；反应恢复期，纠正脱水后，症状逐渐消失（D对），体温、脉搏、血压恢复正常。少数患者可有反应性低热（E对），可能是循环改善后肠内毒素吸收增加所致。